关于右淋巴导管正确的描述是
A. 是全身最大的淋巴导管
B. 收集身体右半身的淋巴回流
C. 由右锁骨下干和右支气管纵隔干合成
D. 由右锁骨下干和右颈干合成
E. 由右锁骨下干、右颈干和右支气管纵隔干合成

正确答案：E。由右锁骨下干、右颈干和右支气管纵隔干合成

解析：胸导管是全身最大的淋巴导管（A错）。右淋巴导管收集右上肢、右胸部和右头颈部即右侧上半身的淋巴（B错）。右淋巴导管由右颈干、右锁骨下干和右支气管纵隔干合成（CD错E对）。